患者，男，32岁，BMI31.1kg/m²，新诊断为2型糖尿病。饮食控制和规律运动3个月后，复查空腹血糖8.5mmol/L，糖化血红蛋白7.5%。首选的降糖药物是
A. 利拉鲁肽
B. 达格列净
C. 胰岛素
D. 格列美脲
E. 二甲双胍

正确答案：E。二甲双胍

解析：本题考查2型糖尿病的药物治疗。2型糖尿病首选且目前最常用的治疗药物是二甲双胍（E对），若无禁忌证，二甲双胍应一直保留在糖尿病的药物治疗方案中。